肌肤初扪之不觉很热，但扪之稍久即感灼手者，为
A. 热在表
B. 热在里
C. 湿热内蕴
D. 虚热证
E. 热在半表半里

正确答案：C。湿热内蕴

解析：肌肤初扪之不觉很热，但扪之稍久即感灼手者，称为身热不扬，为湿热内蕴（C对）。身热初按热甚，久按不热者，是热在表（A错）。久按热愈甚者，为热在里（B错）。